3～6个月婴儿维生素D缺乏性佝偻病激期骨骼改变最常见的表现为
A. 颅骨软化
B. 方颅
C. 前囟增大
D. 腕踝部膨大
E. 肋骨串珠和肋膈沟

正确答案：A。颅骨软化

解析：颅骨软化、方颅、腕踝部膨大、肋骨串珠和肋膈沟都是维生素D缺乏性佝偻病激期骨骼的改变，但是只有颅骨软化属于3-6个月婴儿的表现（A对），其余都是6个月之后才可出现的症状（BDE错）。维生素D缺乏性佝偻病激期可出现的是前囟边变软而不是前囟增大（C错）。